一次污染物是指
A. 由污染源直接排入环境中的化学性污染物，其理化形状保持未变
B. 由污染源直接排入环境中的化学性污染物，发生了物理性变化
C. 由污染源直接排出的化学性污染物，进入环境后与其他物质发生了反应
D. 原来就存在于环境中的化学物
E. 自然环境中的化学物

正确答案：A。由污染源直接排入环境中的化学性污染物，其理化形状保持未变

解析：本题考查一次污染物。一次污染物是指由污染源直接排入大气环境中，其物理和化学性质均未发生变化的污染物（A对BCDE错）。